急性重型肝炎预后良好的标志是
A. 凝血酶原活动度＜40%
B. 胆红素＞17.lμmol/L
C. 碱性磷酸酶明显升高
D. 丙氨酸转氨酶明显升高
E. 甲胎蛋白升高

正确答案：E。甲胎蛋白升高

解析：急性重型肝炎预后良好的标志是甲胎蛋白升高（E对），甲胎蛋白升高提示有肝细胞再生。PTA≤40%是诊断重型肝炎或肝衰竭的重要依据（A错）。胆红素＞17.lμmol/L提示肝功能轻度异常（B错）。碱性磷酸酶明显升高提示胆管梗阻等（C错）。丙氨酸转氨酶明显升高可见于各种病毒性肝炎、酒精肝等（D错）。